根据《药品流通监督管理办法》，关于药品销售的说法，正确的有
A. 药品生产企业不得采用邮售方式直接向公众销售处方药
B. 药品经营企业不得以搭售方式向公众赠送处方药
C. 药品经营企业不得回收有效期将届满的药品重新包装销售
D. 医疗机构不得采用互联网交易方式向公众销售处方药
E. 药品生产企业只能销售本企业生产的药品

正确答案：A、B、C、D、E。药品生产企业不得采用邮售方式直接向公众销售处方药；药品经营企业不得以搭售方式向公众赠送处方药；药品经营企业不得回收有效期将届满的药品重新包装销售；医疗机构不得采用互联网交易方式向公众销售处方药；药品生产企业只能销售本企业生产的药品

解析：本题考查的是药品销售管理。根据《药品流通监督管理办法》，关于药品销售的说法，正确的有药品生产企业不得采用邮售方式直接向公众销售处方药（A对）；药品经营企业不得以搭售方式向公众赠送处方药（B对）；药品经营企业不得回收有效期将届满的药品重新包装销售（C对）；医疗机构不得采用互联网交易方式向公众销售处方药（D对）；药品生产企业只能销售本企业生产的药品（E对）。药品零售企业不得采用开架自选的方式销售处方药，也不得采用“捆绑搭售”“买商品赠药品”“买N赠1”“满N减1”“满N元减×元”等方式直接或变相赠送销售处方药、甲类非处方药（包括通过网络销售的渠道）。药品经营企业不得违法回收或参与回收药品，销售回收药品。《医疗机构药品监督管理办法（试行）》第三章药品调配和使用第二十三条：医疗机构不得采用邮售、互联网交易、柜台开架自选等方式直接向公众销售处方药。